我国卫生部于1988年制定的医务人员医德规范七条内容中，不直接涉及医患关系的是
A. 第2条
B. 第3条
C. 第4条
D. 第5条
E. 第7条

正确答案：E。第7条

解析：中华人民共和国医务人员医德规范：一、救死扶伤，实行社会主义的人道主义，时刻为病人着想，千方百计为病人解除病痛。二、尊重病人的人格和权利，待病人不分民族、性别、职业、地位、财产状况，都应一视同仁。三、文明礼貌服务，举止端庄，语言文明，态度和蔼，同情、关心和体贴病人。四、廉洁奉公，自觉遵纪守法，不以医谋私。五、为病人保守医秘，实行保护性医疗，不泄露病人隐私和秘密。六、互学互尊，团结协作，正确处理同行同事间的关系。七、严谨求实，奋发进取，钻研医术。精益求精，不断更新知识，提高技术水平（E错，为本题正确答案）。